关于窝沟龋的叙述，正确的是
A. 龋损基底部向着釉质牙本质界
B. 口小底大的三角形潜行性龋损
C. 龋损顶部向着窝沟壁
D. 病变易进展到牙本质
E. 以上都正确

正确答案：E。以上都正确

解析：龋损形态也呈三角形，但基底部向着釉质牙本质界，顶部向着窝沟壁。由于窝沟附近的釉柱排列方向为向窝沟底部集中，形成的龋损及形态与釉柱排列方向一致，即口小底大的三角形潜行性龋损，由于釉质在窝沟底较薄，窝沟龋病变很容易进展到牙本质。此种病变在临床上检查时可能无明显龋洞，但其深层已有较大范围的病变。掌握“牙釉质龋”知识点。